益母草颗粒的功能是
A. 活血止血
B. 活血调经
C. 活血行气
D. 活血散寒
E. 破血消癥

正确答案：B。活血调经

解析：本题考查的是益母草颗粒的功能。益母草颗粒的功能是活血调经（B对）。益母草颗粒：【功能】活血调经。云南白药：【功能】化瘀止血，活血（A错）止痛，解毒消肿。血府逐瘀口服液：【功能】活血祛瘀，行气（C错）止痛。小活络丸：【功能】祛风散寒（D错），化痰除湿，活血止痛。千金子：【功效】泻水逐饮，破血消癥（E错）。